中医外科内治法的总则是
A. 温、托、补
B. 清、消、补
C. 清、补、托
D. 消、通、补
E. 消、托、补

正确答案：E。消、托、补

解析：外科内治之法基本与内科相同，但有其特点，除了从整体进行辨证施治外，还要依据外科疾病的发生发展过程，按照疮疡初起、成脓、溃后三个不同发展阶段确立不同的治法，消、托、补三法即为总的治疗原则（E对）。